成瘾性最小的药物是
A. 吗啡
B. 芬太尼
C. 哌替啶
D. 美沙酮
E. 喷他佐辛

正确答案：E。喷他佐辛